升颌肌处在最小收缩状态的是
A. 正中关系位
B. 下颌姿势位
C. 后退接触位
D. 牙尖交错位
E. 铰链位

正确答案：B。下颌姿势位

解析：本题考查颌位。升颌肌处在最小收缩状态的是下颌姿势位（B对）。下颌姿势位时上、下颌牙不发生接触，牙周与颞下颌关节组织不受力，口颌肌群放松，这是口颌系统健康所必需的。正中关系位（A错）：正中关系（CR）是指下颌适居正中，在适当的面部距离（垂直距离），髁突处于关节窝中的前、上位，关节盘-髁突复合体抵住关节结节后斜面时的一种下颌位置关系，此时髁突对上颌的位置关系称为正中关系位（CRP）。后退接触位（C错）：从牙尖交错位（ICP）开始，下颌可以向后下移动少许（约1mm），后牙牙尖斜面保持部分接触，受颞下颌韧带的限制，下颌不能再向后退，是下颌的生理性最后位，下颌的这个位置称为后退接触位（RCP）。牙尖交错位（D错）：是指上下颌牙牙尖交错，达到最广泛、最紧密接触时下颌所处的位置,即牙尖交错（牙合）时下颌骨相对于上颌骨或者颅底的位置关系。